对食物中毒的正确描述是
A. 一种食源性肠道传染病的总称
B. 摄入有毒有害物质的食品而引起的非传染性急性、亚急性疾病
C. 长期摄入过量食物后引起的非传染性急性、亚急性疾病
D. 长期摄入某些有毒有害食品引起的慢性毒害性疾病
E. 由致病性细菌引起的食源性疾病的总称

正确答案：B。摄入有毒有害物质的食品而引起的非传染性急性、亚急性疾病

解析：食物中毒是指食用了被有毒有害物质污染的食品或者食用了含有毒有害物质的食品后出现的一种不会在人与人之间直接传染的急性、亚急性疾病（B对）。食源性肠道传染病是由于自然灾害对基本生活条件的破坏，造成食品供应不足，人们被迫在恶劣条件下储存食品，加工食品造成食品的腐败和霉变所引起的传染性疾病（A错）。食物中毒属于食源性疾病之一，它不包括因暴食暴饮而引起的急性胃肠炎、食源性肠道传染病和寄生虫病、食物过敏，也不包括因一次大量或长期少量多次摄人某些有毒、有害物质而引起的以慢性中毒为主要特征的疾病。长期摄入过量食物会造成肥胖的发生（C错）。长期摄入某些有毒有害食品引起的慢性毒害性疾病是由食物中的有毒物质引起的一种慢性疾病（D错）。由致病性细菌或其毒素污染的食品引起的是细菌性食物中毒（E错）。